对病因不明疾病，描述性研究的主要任务是
A. 早期发现患者
B. 寻找病因线索
C. 确定病因
D. 验证病因
E. 因果推断

正确答案：B。寻找病因线索